已感染的伤口的处理原则为
A. 清创后不予缝合
B. 清创后一期缝合
C. 清创后延期缝合
D. 加强换药处理
E. 外敷药膏治疗

正确答案：D。加强换药处理